下列关于津枯血燥形成原因的叙述，错的是
A. 高热伤津
B. 烧伤耗津
C. 失血脱液
D. 痰瘀阻津
E. 阴虚痨热

正确答案：D。痰瘀阻津

解析：津枯血燥，主要指津液亏乏枯竭，导致血燥虚热内生或血燥生风的病理状态。热盛伤津（A对）、失血脱液（C对），或烧伤而使津液大亏（B对），或因阴虚痨热（E错）津液暗耗都会导致津液亏乏枯竭，进而发为津枯血燥（D错，为本题正确答案）。